根据《化学药品和治疗用生物制品说明书规范细则》，需要慎用某药品（如肝、肾功能问题）的内容应列在
A. 适应症
B. 不良反应
C. 药物相互作用
D. 注意事项
E. 禁忌

正确答案：D。注意事项

解析：本题考查药品说明书的格式和书写要求。需要慎用某药品（如肝、肾功能问题）的内容应列在【注意事项】（D对）。处方药应当列出使用时必须注意的问题，包括需要慎用的情况（如肝、肾功能的问题），影响药物疗效的因素（如食物、烟、酒），用药过程中需观察的情况（如过敏反应，定期检查血象、肝功能、肾功能）及用药对于临床检验的影响等。【适应症】（A错）化学药品标“适应症”，中药标“功能主治”。它是药品生产企业在充分的动物药效学实验及临床人体实验的基础上确定的，并经药品监督管理部门审核后才允许刊印，往往包含很多适应症或功能和主治，有的也标明药理作用和用途。【不良反应】（B错）药品的各种不良反应包含在这一栏中。【药物相互作用】（C错）应列出与该药产生相互作用的药品或者类别，并说明相互租用的结果及合并用药的注意事项。【禁忌】（E错）应列出该药品不能应用的各种情况。